下列哪项不是脾的生理功能
A. 受纳和腐熟水谷
B. 转输水谷精微
C. 吸收和转输水液
D. 维系脏器位置
E. 统摄血液

正确答案：A。受纳和腐熟水谷

解析：脾有运化水谷的功能，消化饮食，把饮食的精华运输全身，所以说脾是后天之本（B对）。脾又能统摄周身血液、调节血液循环，使之正常运行（E对）。脾气主升，能把饮食中的精气、津液上输于肺，并且维持内脏位置的相对稳定（D对）。脾能运化水湿，和水液的代谢有关（C对）。同时脾还与四肢、肌肉等有关，如脾的运化功能正常，四肢活动有力，肌肉丰满壮实。受纳和腐熟水谷是胃的生理功能（A错，为本题正确答案）。